患者，女，60岁，初戴全口义齿，医师检查发现在正中（牙合）接触时，咬合接触点少若检查发现前伸（牙合）时仅有后牙接触，前牙不接触，应调磨的位置是
A. 上后牙舌尖和下后牙颊尖
B. 上后牙颊尖近中斜面和下后牙颊尖远中斜面
C. 上后牙颊尖远中斜面和下后牙舌尖近中斜面
D. 上后牙颊尖和下后牙舌尖
E. 上后牙颊尖近中斜面和下后牙舌尖远中斜面

正确答案：C。上后牙颊尖远中斜面和下后牙舌尖近中斜面

解析：本题考查全口义齿选磨调牙合的方式。患者初戴全口义齿，正中牙合接触时，咬合接触点少（咬合异常）若检查发现前伸牙合时仅有后牙接触，前牙不接触（前伸牙合后牙牙合干扰），应调磨的位置是上颌牙颊尖远中斜面和下颌牙舌尖近中斜面（C对），调磨应同时遵守BULL法则和DUML法则。上后牙舌尖和下后牙颊尖（A错）适用于平衡侧牙合干扰发生在上颌后牙舌尖的颊斜面和下颌后牙颊尖的舌斜面之间，且牙尖在正中咬合存在早接触的情况。上后牙颊尖和下后牙舌尖（D错）的调磨适用于上颌牙颊尖和下颌牙或下颌牙舌尖与上颌牙的早接触。上后牙颊尖近中斜面和下后牙颊尖远中斜面（B错）与上后牙颊尖近中斜面和下后牙舌尖远中斜面（E错）均非互相接触的斜面，调磨不能改善牙合接触。